口腔淋巴上皮囊肿好发部位为
A. 颊部黏膜
B. 舌
C. 硬腭
D. 腮腺
E. 舌下腺

正确答案：B。舌

解析：口腔淋巴上皮囊肿好发部位包括口底、舌、软腭等处。掌握“鳃裂囊肿”知识点。